对于应用甲氨蝶呤引起的巨幼红细胞性贫血，治疗时应选用
A. 维生素B₁₂
B. 叶酸
C. 叶酸+维生素B₁₂
D. 甲酰四氢叶酸钙
E. 红细胞生成素

正确答案：D。甲酰四氢叶酸钙

解析：甲氨蝶呤所致的巨幼红细胞性贫血，因二氢叶酸还原酶受抑制，四氢叶酸生成障碍，应用一般叶酸制剂无效，须直接选用甲酰四氢叶酸钙治疗（D对）。维生素B₁₂（A错）为细胞分裂和维持神经组织髓鞘完整所必须，临床主要用于恶性贫血及巨幼红细胞性贫血，也可作为神经系统疾病、肝脏疾病等的辅助治疗。叶酸（B错）属于水溶性B族维生素，进入体内后，在二氢叶酸还原酶作用下形成具有活性的四氢叶酸，作为甲基等一碳基团的传递体，参与嘌呤、嘧啶等物质的合成，叶酸缺乏时影响，导致DNA合成减少，细胞分裂与增殖受抑制，出现巨幼红细胞贫血，临床用于各种原因所致的巨幼红细胞贫血，对恶性贫血、维生素B₁₂缺乏所致的巨幼红细胞性贫血，叶酸可纠正血象，但不能改善神经损害症状，所以治疗以叶酸治疗为主，辅以维生素B₁₂（C错），效果良好。红细胞生成素（E错）主要治疗肾性贫血，肾衰血液透析的贫血，恶性肿瘤、化疗及艾滋病药物治疗等引起的贫血。